一经产妇38岁，妊娠39周，在家中请接生婆接生，胎儿娩出后，有新鲜血流出，胎盘出完整，产妇产后一个小时阴道大出血估计有两大碗，接生婆认为子宫收缩好，产妇一般状态好，呼吸平稳，又观察2个小时，阴道出血不见减少，而后转诊到县医院，检查产妇血压为零，脉搏不清，阴道左侧壁裂伤至穹隆顶端，宫颈裂伤有4cm以上，经抢救无效死亡。该产妇曾孕4产2，引产1次，既往健康，本次妊娠未接受产前检查，认为曾经顺利分娩两次，在家分娩不会有问题。最可能发生产后出血主要原因是
A. 子宫收缩乏力
B. 胎盘滞留
C. 软产道裂伤
D. 血液病
E. 羊水栓塞

正确答案：C。软产道裂伤

解析：本题考查软产道裂伤的临床表现。该病历提示该产妇既往健康，分娩过程胎盘完整娩出，子宫收缩好，产妇产后1个小时一般状态好，呼吸平稳，所以可排除胎盘滞留、子宫收缩乏力、血液病、羊水栓塞；由于胎儿娩出后，有新鲜血流出，县医院检查产妇阴道左侧壁裂伤至穹隆顶端，宫颈裂伤有4cm以上，因此支持软产道裂伤（C对ABDE错）诊断。